下列各项，属进入第二产程征象的是
A. 产妇屏气向下用力
B. 胎头部分露于阴道
C. 产妇排尿困难
D. 子宫口开全
E. 脐带脱出于阴道口外

正确答案：D。子宫口开全

解析：第二产程征象为从宫口开全（D对）至胎儿娩出，此时需指导产妇屏气，它不是标志（A错）。第一产程标志为规律宫缩至宫口开全，临床表现为规律宫缩；宫口扩张；胎头下降，直到先露部到达外阴及阴道口（B错）；胎膜破裂；母体会有精神的影响应当给予安慰，若血压上升应当给予相应处理，鼓励少量多次进食，若排尿或排便困难等需进行导尿，灌肠等（C错）。第三产程标志为胎儿娩出至胎盘胎膜娩出，临床表现有胎盘剥离征象：子宫体变硬呈球形，宫底上升达脐上；剥离的胎盘降至子宫下段，阴道口外露的一段脐带自行延长（E错）；阴道少量出血；在产妇耻骨联合上方轻压子宫下段时，宫体上升而外露的脐带不再回缩。